肺泡表面张力来自
A. 肺泡表而活性物质
B. 肺泡表面液体薄层
C. 肺泡上皮细胞
D. 间质
E. 毛细血管基膜和内皮细胞

正确答案：B。肺泡表面液体薄层